宫颈病理切片报告为“鳞状上皮化”，是指
A. 癌前病变
B. 原位癌
C. 浸润癌
D. 糜烂愈合过程
E. 宫颈糜烂的类型

正确答案：D。糜烂愈合过程

解析：鳞状上皮化:子宫颈阴道部鳞状上皮直接长入柱状上皮与其基底膜之间，直至柱状上皮完全脱落而被鳞状上皮替代(P302）；多见于宫颈糜烂愈合过程中（八年制妇产科学第二版P317）（D对）。转化区成熟的化生鳞状上皮对致癌物的刺激相对不敏感（A错），但未成熟的化生鳞状上皮却代谢活跃，形成CIN。原位癌（B错）病理检查显示为一种无规律的表皮增生，正常上皮细胞被许多异形或多核奇异细胞所代替，上皮基底膜完整。浸润癌（C错）是原位癌的癌细胞继续发展，穿透基底膜，侵入固有层或粘膜下的表层。宫颈糜烂只是一个临床征象，宫颈糜烂的实质为柱状上皮异位（E错）。